上下牙咬合时，牙周组织所承受实际咀嚼力量称为
A. （牙合）力
B. 咀嚼效率
C. 咀嚼肌力
D. 咀嚼周期
E. 牙周潜力

正确答案：A。（牙合）力

解析：本题考查（牙合）力。上下牙咬合时，牙周组织所承受实际咀嚼力量称为（牙合）力（A对）。1.咀嚼的主要功能之一是粉碎食物，使其能被吞咽和消化。机体在一定时间内，对定量食物嚼细的程度，称为咀嚼效率（B错）。咀嚼效率是咀嚼作用的实际效果，也是衡量咀嚼能力大小的一个重要生理指标。2.参与咀嚼的肌肉所能发挥的最大力量为咀嚼肌力（C错），也称咀嚼力。3.咀嚼运动是复杂的综合性运动，但下颌运动有其一定的程序和重复性，此种程序和重复性称为咀嚼周期（D错）。4.牙周潜力（E错）是指在咀嚼各种食物时，并不需要很大的（牙合）力，而牙齿及牙周支持组织，尚有很大的潜力。